关于卫生服务研究，下列叙述不正确的是
A. 卫生服务研究是以卫生服务的供方、需方和第三方作为研究对象的
B. 卫生服务研究的方法主要是综合评价法
C. 卫生服务研究可分为卫生系统研究、卫生工作研究、防治效果研究及行为医学研究等
D. 卫生服务研究的目的是将有限的卫生资源更好地分配和利用

正确答案：B。卫生服务研究的方法主要是综合评价法

解析：本题考查卫生服务研究。卫生服务研究是从卫生服务的供方、需方和第三方（如决策方、医疗保险公司等）及其相互之间的关系出发（A对），研究卫生系统为一定的目的合理使用卫生资源，向居民提供预防、保健、医疗、康复、健康促进等卫生服务的过程。卫生服务研究的根本目的是为了科学合理组织卫生事业，以有限的卫生资源尽可能地满足广大居民的卫生服务需要（D对），从而提高居民的健康水平和生活质量，改善社会卫生状况。卫生服务研究可分为卫生系统研究、卫生工作研究、防治效果研究及行为医学研究等（C对）。卫生服务研究的方法有描述性研究、分析性研究、实验性研究、数学模型方法、系统分析法、综合评价法、投入产出分析法和家庭健康询问抽样调查（B错，为本题正确答案）。